农民在劳动过程中因吸入某些粉尘可突然引起急性发作，此时多表现发烧、寒战、胸闷、气促、干咳等症状，称为农民肺，是一种典型的外源性变应性肺泡炎。这主要是因吸入下列粉尘中的哪一种，请指出
A. 新的谷物粉尘
B. 田间飞扬的尘土
C. 喷洒的化肥尘
D. 飞扬的人畜粪肥尘
E. 发霉的干草或蔗渣尘

正确答案：E。发霉的干草或蔗渣尘